初产妇，26岁。因第二产程延长行产钳助产，产后阴道流血约800ml，诊断为子宫收缩乏力所致，其主要临床表现应是
A. 胎盘剥离延缓而出血
B. 胎盘娩出后出血无血块
C. 胎盘未娩出时出血不止
D. 胎儿娩出后立即出血不止
E. 胎盘娩出后阵发性出血量多

正确答案：E。胎盘娩出后阵发性出血量多